利尿药抗心衰的作用机制是
A. 只减轻前负荷
B. 只减轻后负荷
C. 既减轻前负荷又减轻后负荷
D. 改善心脏泵血功能
E. 改善心脏泵血功能

正确答案：C。既减轻前负荷又减轻后负荷

解析：心衰患者体内多有水钠潴留，由于血容量增加，加重了心脏的前负荷；由于血管壁平滑肌细胞内Na⁺含量增加，通过Na⁺-Ca²⁺交换，增加了细胞内Ca²⁺含量，使血管平滑肌张力升高，外周阻力加大，加重了心脏的后负荷，利尿药可促进Na⁺和水的的排除，从而减轻心脏的前负荷（B错），同时Na⁺浓度降低，Na⁺-Ca²⁺交换降低，细胞内Ca²⁺含量降低，使血管平滑肌张力降低，外周阻力减小，减轻了心脏的后负荷（C对A错）。强心苷等正性肌力药抗心力衰竭的机制是正性肌力作用（E错），增强心肌收缩力，改善心脏泵血功能（D错）。